女，60岁，高温天气户外活动4小时，出现口渴、尿少，突然晕倒。最可能的原因是
A. 稀释性低钠血症
B. 等渗性缺水
C. 急性肾衰竭
D. 高渗性缺水
E. 低渗性缺水

正确答案：D。高渗性缺水

解析：患者老年女性，高温天气户外活动后出现口渴、尿少且突然晕倒最有可能的原因是高渗性缺水（D对）。高渗性缺水（P11）常见于水分摄入不足或丢失过多的情况，主要表现为口渴、尿少，重度缺水者还可出现躁狂、幻觉、谵妄，甚至昏迷。稀释性低钠血症（P13）（A错）又称水中毒，临床较少发生，患者多有摄入水分过多或接受过多的静脉输液等病史，主要表现为头痛、嗜睡、精神紊乱等症状；等渗性缺水（B错）与低渗性缺水（E错）不会出现口渴的症状；急性肾衰竭（C错）是指由多种病因引起的肾功能快速下降而出现的临床综合症，会出现恶心、呕吐、呼吸困难、高血压、心力衰竭等一系列全身性表现。本例患者除口渴、尿少、昏迷外无其他表现，不支持急性肾衰竭的诊断。